制定生长发育标准使用均数和标准差概念的理论依据是
A. 正常儿童的多数生长发育指标呈正态分布
B. 正常儿童的多数生长发育指标呈偏态分布
C. 正常儿童的多数生长发育指标呈对数分布
D. 正常儿童的多数生长发育指标呈半对数分布
E. 正常儿童的多数生长发育指标呈偏态分布

正确答案：A。正常儿童的多数生长发育指标呈正态分布